饮水氯化消毒副产物不包括
A. 氯乙酸
B. 溴乙酸
C. 次氨酸
D. 溴仿
E. 氯仿

正确答案：C。次氨酸

解析：本题考查饮水氯化消毒副产物。氯化消毒副产物系指在氯化消毒过程中的氯与水中有机物反应所产生的卤代烃类化合物。最常见的氯化消毒副产物有两大类：①挥发性卤代有机物：主要有三卤甲烷，包括三氯甲烷、一溴二氯甲烷、二溴一氯甲烷、溴仿（D对）、氯仿（E对）；②非挥发性卤代有机物：主要有卤代乙酸，如氯乙酸（A对）、二氯乙酸、三氯乙酸、溴乙酸（B对）、二溴乙酸、三溴乙酸、溴氯乙酸、二溴一氯乙酸、二氯一溴乙酸等；此外还有卤代醛、卤代酚、卤代腈、卤代酮、卤代羟基呋喃酮等。饮水氯化消毒副产物不包括次氨酸（C错，为本题正确答案）。